女性，38岁，健康查体发现右前上纵隔椭圆形阴影，边界清晰，密度均匀，与周围组织界线明显，首先考虑诊断可能是
A. 胸腺瘤
B. 淋巴瘤
C. 神经源性肿瘤
D. 心包囊肿
E. 支气管囊肿

正确答案：A。胸腺瘤